下列关于Garré骨髓炎的说法，不正确的是
A. 慢性骨髓炎伴增生性骨膜炎
B. Garré慢性非化脓性硬化性骨髓炎
C. 骨化性骨膜炎
D. 多见于颌骨肿瘤的骨质病变
E. 是一种骨膜炎症反应的慢性骨髓炎

正确答案：D。多见于颌骨肿瘤的骨质病变

解析：慢性骨髓炎伴增生性骨膜炎又称为Garré骨髓炎、Garré慢性非化脓性硬化性骨髓炎或骨化性骨膜炎。是一种伴明显骨膜炎症反应的慢性骨髓炎亚型。多由于慢性根尖周炎、牙周炎或拔牙创感染的持续存在，导致骨膜下反应性新骨形成。掌握“Garré骨髓炎及致密性骨炎”知识点。